按十二经脉的流注次序，肝经向下流注的经脉是
A. 膀胱经
B. 胆经
C. 三焦经
D. 心经
E. 肺经

正确答案：E。肺经

解析：该题考查十二经脉的循行走向交接规律。记忆：十二经脉的流注次序的记忆小口诀为肺大胃脾心小肠，膀肾包焦胆肝详（E对ABCD错）。